世界第一个心理卫生协会“康涅狄格州心理卫生协会”成立于
A. 1900年
B. 1908年
C. 1918年
D. 1928年
E. 1938年

正确答案：B。1908年

解析：1908年美国一位大学生比尔斯（C.Beers）以自己患精神病后又恢复健康的亲身体验所著的《一颗失而复得的心》（AMindThatItFoundItself）又一次使心理卫生运动得以迅速发展。他使人们了解到当时精神病患者被当作疯子，在近乎监狱的精神病院中所遭受的非人的待遇，最终结束了这样的“看护”和“管理”。这次心理卫生运动迅速得到医生、心理学家、精神病学家及社会各界的广泛支持，并于1908年5月成立了世界第一个心理卫生协会“康涅狄格州心理卫生协会”办会的宗旨有五项：保持心理健康；防治心理疾病；提高精神病患者的待遇；普及关于心理疾病的正确认识；与心理卫生有关的机构合作。掌握“心理健康概述”知识点。